治疗各种革兰阴性杆菌有效的药物是
A. 阿米卡星
B. 万古霉素
C. 利福平
D. 盐酸克林霉素
E. 红霉素

正确答案：A。阿米卡星

解析：本题考查阿米卡星。阿米卡星（A对）属于氨基糖苷类抗菌药，对各种革兰阴性菌具有强大抗菌活性。万古霉素（B错）对革兰阳性菌具有强大的抗菌活性。利福平（C错）对结核杆菌和麻风杆菌作用强。盐酸克林霉素（D错）对需氧革兰阳性球菌和厌氧菌有良好抗菌活性。红霉素（E错）抗菌谱包括革兰阳性球菌、革兰阴性球菌、部分革兰阴性杆菌、非典型致病原和厌氧消化球菌。